豆豉在发酵过程中，由于微生物的作用含量增加的营养素是
A. 维生素A
B. B族维生素
C. 维生素C
D. 维生素D
E. 蛋白质

正确答案：B。B族维生素

解析：本题考查豆豉在发酵过程中，由于微生物的作用含量增加的营养素。豆豉在发酵过程中，由于微生物的作用可合成维生素B₂，豆豉中含维生素B₂（B对ACDE错）可达0.61mg/100g。